焚烧炉内焚烧废弃物或尸体，此种方法为
A. 焚烧法
B. 烧灼法
C. 巴氏消毒法
D. 煮沸法
E. 高压蒸汽灭菌法

正确答案：A。焚烧法

解析：焚烧法：是一种较彻底的灭菌方法，在焚烧炉内焚烧尸体及废弃物，可杀灭细菌芽孢（胞）。掌握“消毒与灭菌”知识点。